下列哪项属于牙体缺损修复的治疗原则
A. 正确的恢复形态与功能
B. 患牙预备时尽可能保存保护牙体组织
C. 修复体应保证组织健康
D. 修复应合乎抗力形和固位形的要求
E. 以上均是

正确答案：E。以上均是

解析：修复治疗的原则：①正确地恢复形态与功能；②患牙预备时尽可能保存、保护牙体组织；③修复体应保证组织健康；④修复应合乎抗力形与固位形的要求。掌握“牙体缺损修复治疗原则”知识点。